某项吸烟与肺癌关系的病例对照研究结果中，对照组平均年龄高于病例组，P﹤0.05，OR＝3（P﹤0.05），下列结论正确的是
A. 两组均衡性不好
B. 实际OR﹤3，不能认为吸烟与肺癌有联系
C. 实际OR﹥3，吸烟与肺癌的联系强度相当大
D. 不能下任何结论，研究完全失败
E. 吸烟对于年龄较大的人危险性较小

正确答案：A。两组均衡性不好